食用某一种毒蕈后，会引起体内大部分器官发生细胞变性，其毒素属细胞原浆毒，中毒后病情凶险，死亡率高，这种毒蕈为
A. 毒蝇伞
B. 鹿花蕈
C. 白毒伞
D. 胶陀螺
E. 花褶伞

正确答案：C。白毒伞